易风化的饮片是
A. 海藻
B. 巴豆
C. 芒硝
D. 乳香
E. 山药

正确答案：C。芒硝

解析：本题考查的是中药饮片分类保管养护品种表。易风化的饮片是芒硝（C对）。中药饮片分类保管养护品种：1.易生虫饮片：党参、人参、南沙参、冬虫夏草、当归、独活、白芷、防风、板蓝根、甘遂、生地、泽泻、全瓜蒌、枸杞子、大皂角、桑葚、龙眼肉、核桃仁、莲子、薏苡仁、杏仁、青风藤、桑白皮、鹿茸、蕲蛇、鸡内金、菊花、金银花、凌霄花、北沙参、防己、莪术、川贝母、金果榄、佛手、陈皮、砂仁、酸枣仁、红花、闹羊花、蒲黄、芫花、蝉蜕、黄柏、狗肾、地龙、甘草、黄芪、山药（E错）、天花粉、桔梗、灵芝、猪苓、茯苓、水蛭、僵蚕、蜈蚣、乌药、葛根、丹参、何首乌、赤芍、苦参、延胡索、升麻、萆薢、大黄、肉豆蔻、淡豆豉、柴胡、地榆、川芎、半夏、玉竹。2.易发霉饮片：天冬、牛膝、独活、玉竹、黄精、白果、橘络、全瓜蒌、山茱萸、莲子心、枸杞子、大枣、马齿苋、大蓟、小蓟、大青叶、桑叶、哈蟆油、鹿筋、狗肾、水獭肝、蛤蚧、黄柏、白鲜皮、川槿皮、人参、党参、当归、知母、紫菀、菊花、红花、金银花、白及、木香、五味子、洋金花、蝼蛄、地龙、蕲蛇、蜈蚣、甘草、葛根、山柰、青皮、芡实、薏苡仁、栀子、羌活、黄芩、远志。3.易泛油饮片：独活、火麻仁、核桃仁、榧子、千金子、当归、牛膝、巴豆（B错）、狗肾、木香、龙眼肉、橘核、杏仁、蝼蛄、前胡、川芎、白术、苍术。4.易变色饮片：月季花、白梅花、玫瑰花、款冬花、红花、山茶花、金银花、扁豆花、橘络、佛手、通草、麻黄。5.易失去气味饮片：广藿香、香薷、紫苏、薄荷、佩兰、荆芥、细辛、肉桂、花椒、月季花、玫瑰花、吴茱萸、八角茴香、丁香、檀香、沉香、厚朴、独活、当归、川芎。6.易升华饮片：樟脑、薄荷脑、冰片。7.易软化融化类饮片：松香、芦荟、阿魏、猪胆膏、白胶香、安息香、柿霜、乳香（D错）、没药、苏合香。8.易风化饮片：硼砂、白矾、绿矾、芒硝、胆矾。9.易潮解饮片：芒硝、大青盐、绿矾、胆矾、硼砂、咸秋石、盐附子、全蝎、海藻（A错）、昆布。